对烫烧伤的儿童以下哪项措施是错误的
A. 迅速将小儿抢离火场或脱离烫伤源
B. 迅速将烫烧伤部位衣服撕掉
C. 用清洁被单包裹
D. 较小灼伤可清洁创面
E. 冷水降温

正确答案：B。迅速将烫烧伤部位衣服撕掉

解析：本题考查儿童烫烧伤的急救处理。切勿将烫烧伤部位衣服撕掉（B错，为本题正确答案），如衣服和皮肤粘在一起时，只能将未粘的部分剪去，粘着的部分让其留在皮肤上待后处理。儿童烫烧伤的急救处理：迅速将小儿抢离火场或脱离烫伤源（A对），并用清洁被单将其包裹（C对），可冷水降温（E对），如较小灼伤可清洁创面（D对）。